正常覆（牙合）时，下颌前牙切缘咬在上颌前牙舌面的部位是
A. 对刃
B. 切1/3以内
C. 中1/3以内
D. 颈1/3以内
E. 超过颈1/3

正确答案：B。切1/3以内

解析：本题考查正常覆（牙合）。覆（牙合）是指牙尖交错（牙合）时上颌牙盖过下颌牙唇颊面的垂直距离，对于前牙，指上颌切牙切缘与下颌牙切缘之间的垂直距离，正常约2～4mm，正常覆（牙合）时，下颌前牙切缘咬在上颌前牙舌面的部位为切1/3以内（B对）。超过者为深覆（牙合）。深覆（牙合）可分为：Ⅰ°深覆（牙合），上颌切牙盖过下颌切牙牙冠中1/3以内者（C错）；Ⅱ°深覆（牙合），咬在颈1/3以内（D错）；Ⅲ°深覆（牙合），超过颈1/3以上（E错）。